属长骨
A. 肋骨
B. 顶骨
C. 鼻骨
D. 趾骨
E. 舌骨

正确答案：D。趾骨

解析：趾骨呈长管状，分为一体两端，属于长骨（D对）。肋骨和顶骨属于扁骨（AB错）。